急性心肌梗死时最常见的心律失常是
A. 心房颤动
B. 室性期前收缩及室性心动过速
C. 房室传导阻滞
D. 预激综合征
E. 非阵发性交界性心动过速

正确答案：B。室性期前收缩及室性心动过速

解析：室颤是急性心肌梗死早期主要的死因，故急性心肌梗死时最常见的心律失常是室性期前收缩及室性心动过速（B对），缓慢性心律失常中以房室传导阻滞最为常见（C错），束支传导阻滞和窦性心动过缓也较多见。